下列哪项不是血瘀证的表现
A. 面色黧黑
B. 肌肤甲错
C. 局部刺痛
D. 唇甲青紫
E. 头晕目眩

正确答案：E。头晕目眩

解析：患者血行瘀滞，则血色变紫、变黑，故见面色黧黑（A对）、唇甲青紫（D对）；血行障碍，气血不能濡养肌肤，则见皮肤干涩、肌肤甲错（B对）；血瘀，气血运行受阻，不通则痛，故有刺痛、固定、拒按等特点（C对）。患者气虚，气虚推动乏力，清阳不升，头目失养，则头晕目眩（E错，为本题正确答案）。